当混合使用分别用次氯酸和盐酸为主要成分的两种洗涤剂时，会造成人体中毒，其主要污染物可能是
A. 氯酸
B. 盐酸
C. 次氯酸
D. 氯气
E. 氮气

正确答案：D。氯气

解析：本题考查混合使用洗涤剂时产生的污染物。当混合使用分别用次氯酸和盐酸为主要成分的两种洗涤剂时，会产生氯气（D对ABCE错），引起氯气中毒，严重损害人体健康。